静注时可产生短暂升压作用的抗高血压药是
A. 利舍平
B. 硝普钠
C. 硝苯地平
D. 胍乙啶
E. 可乐定

正确答案：E。可乐定